治疗癫痫大发作和局限性发作的药物
A. 乙琥胺
B. 地西泮
C. 氯丙嗪
D. 苯妥英钠
E. 异丙嗪

正确答案：D。苯妥英钠

解析：治疗癫痫大发作和局限性发作的药物苯妥英钠（D对）。乙琥胺（A错）为临床治疗癫痫小发作（失神性发作）的首选药，对其他类型癫病无效（P127）。地西泮（B错）是治疗癫病持续状态的首选药物（P128）。氯丙嗪（C错）为抗精神分裂症药（P143-P145）。